各段肾小管比较，重吸收量居首位的是
A. 近球小管
B. 髓袢降支细段
C. 髓袢升支细段
D. 远曲小管
E. 集合管

正确答案：A。近球小管